鼠咬热螺菌属于
A. 球菌
B. 杆菌
C. 真菌
D. 螺形菌
E. 放线菌

正确答案：D。螺形菌

解析：螺形菌分为：①弧菌，如霍乱弧菌；②螺菌，如鼠咬热螺菌；③螺杆菌，如幽门螺杆菌。掌握“细菌的大小、形态和基本结构”知识点。